与气的生成关系最密切的脏是
A. 心与脾
B. 肺与脾
C. 脾与肾
D. 肺与肝
E. 肺与心

正确答案：B。肺与脾

解析：肺与脾的关系，主要表现在气的生成与水液代谢两个方面（B对）。心与脾的关系，主要表现在血液生成方面的相互为用及血液运行方面的相互协同（A错）。脾为后天之本，肾为先天之本，脾肾两者首先表现为先天与后天的互促互助关系；脾主运化水液，肾为主水之脏，脾肾的关系还表现在水液代谢方面（C错）。肝主升发，肺主肃降。肺与肝的生理联系，主要体现在人体气机升降的调节方面（D错）。心与肺的关系，主要表现在血液运行与呼吸吐纳之间的协同调节关系（E错）。